下列哪种物质对胆碱酯酶的合成有影响
A. 汞
B. 铅
C. 砷
D. 有机磷
E. 锰

正确答案：E。锰